有关药典的表述，正确的有
A. 药典是一个国家记载药品标准、规格的法典
B. 中国药典由凡例、正文和附录等主要部分构成
C. 国际药典由世界卫生组织编纂
D. 国际药典对各国有法律约束力
E. 药典收载的品种是那些疗效确切、副作用小、质量稳定的常用药品及其制剂

正确答案：A、B、C、E。药典是一个国家记载药品标准、规格的法典；中国药典由凡例、正文和附录等主要部分构成；国际药典由世界卫生组织编纂；药典收载的品种是那些疗效确切、副作用小、质量稳定的常用药品及其制剂